年轻恒牙牙髓治疗原则为
A. 保留牙齿，维持间隙
B. 去除牙髓感染，修复牙齿外形
C. 恢复咀嚼功能，促进颌骨发育
D. 尽可能保护活髓和牙乳头
E. 保留牙齿，恢复咀嚼功能

正确答案：D。尽可能保护活髓和牙乳头

解析：本题考查年轻恒牙牙髓病及根尖周病诊断及治疗。年轻恒牙萌出后，牙根的继续发育有赖于牙髓的作用。因此，在牙髓病的治疗中，保存生活牙髓应是最有益于年轻恒牙的首选治疗。治疗原则是尽力保存生活的牙髓组织。如不能保存全部活髓，也应保存根部活髓。不能保存根部活髓时，根尖尚未形成者，也应保存根部的牙乳头（D对）。不能保存活髓，也应尽量保存牙齿。